女，32岁，有心脏病病史4年。最近感到心悸，听诊发现心率100次/分，心律绝对不齐，第一心音强弱不等，心尖部有舒张期隆隆样杂音。为进一步确诊心律失常的类型应首选
A. 嘱病人左侧卧位听诊
B. 嘱病人屏气后听诊
C. 心电图检查
D. 超声心动图
E. X线胸片

正确答案：C。心电图检查

解析：女性青年患者，有心脏病史4年，心尖部有舒张期隆隆样杂音（二尖瓣狭窄特征性杂音）；律不齐，第一心音强弱不等（心房颤动的典型体征），故患者最可能诊断为二尖瓣狭窄伴心房颤动。为进一步检查心律失常性质应首选心电图检查（C对）。房颤（P188）心电图表现包括：①P消失，代之以小而规则的基线波动，形态与振幅均变化不定的f波，频率约350～600次/分；②心室率极不规则；③QRS波形态通常正常，当心室率过快，发生室内差异性传导，QRS波增宽变形。左侧卧位可使二尖瓣狭窄的舒张期隆隆样杂音更明显（九版诊断学P163）。因左侧卧位时，可使心脏更贴近胸壁，同时血液由于重力影响流入左室亦可加速，故杂音可以增强。若在改为左侧卧位前，嘱病人稍加活动，就更容易听到。故嘱病人左侧卧位听诊（A错）主要是帮助听诊心脏杂音。嘱病人屏气后听诊（B错）也帮助听诊心脏杂音，不用于心律失常的诊断。超声心动图（P159）（D错）能直观的显示心脏的结构和运动状态，主要用于心力衰竭的辅助诊断。X线胸片（P160）（E错）能显示心脏大血管的大小、形态位置和轮廓，能观察心脏与毗邻器官的关系和肺内血管的变化，是确诊左心衰竭肺水肿的主要依据。